内耳是颞骨内呈盘卷状充满液体的管腔。内有感知位置觉和听觉的感受器，是前庭蜗器的功能中心结构。膜迷路不包括
A. 蜗管
B. 膜半规管
C. 前庭
D. 椭圆囊
E. 球囊

正确答案：C。前庭

解析：膜迷路由椭圆囊（D对）和球囊（E对）、膜半规管（B对）和蜗管（A对，故C为本题正确答案）3 部分组成。